复发性流产是指连续自然流产
A. 2次以上
B. 3次以上
C. 4次以上
D. 5次以上
E. 以上都不是

正确答案：B。3次以上

解析：复发性流产是指连续与同一性伴侣连续自然流产3次及以上者。掌握“自然流产”知识点。